月经量多色黑且有血块，已持续3周，少腹疼痛拒按，舌边瘀点，脉细涩。方选
A. 固本止崩汤
B. 左归丸合二至丸
C. 清热固经汤
D. 逐瘀止血汤
E. 通瘀煎

正确答案：D。逐瘀止血汤

解析：根据患者“月经持续3周且量多色黑有血块”，可辨病为崩漏，同时伴有“少腹疼痛拒按，舌边瘀点，脉细涩”可辨证为血瘀证。冲任、子宫瘀血阻滞，新血不安，故经血量多且淋沥不断，持续3周；瘀阻冲任、子宫，不通则痛，故小腹疼痛拒按；经血色黑有血块，舌边瘀点，脉细涩均为血瘀的表现。治宜活血化瘀，固冲止血，方选逐瘀止血汤或将军斩关汤（D对）。固本止崩汤功效补益气血，固冲止崩，可用于治疗崩漏脾虚证（A错）。二至丸功效补益肝肾，滋阴止血；左归丸功用滋阴补肾，填精益髓，主治真阴不足证；两方合用共奏滋肾益阴，止血调经之功，用于治疗崩漏肾阴虚证（B错）。清热固经汤功效清热凉血，止血调经，用于治疗崩漏之实热证（C错）。通瘀煎功效活血祛瘀，行气止痛，主治妇人气滞血积，经脉不利，痛极拒按（E错）。